患者男性，32岁，6天前感冒后出现左下后牙区胀痛，进食、吞咽时加重。昨日起出现局部自发性跳痛，张口受限，低热，头痛，检查可见：左下颌角区颊部稍肿胀，无压痛，张口度两指，左下第三磨牙近中阻生牙龈红肿充血，挤压可见远中盲袋内少量脓液溢出，颊侧前庭沟丰满、充血，压痛明显、叩诊（-），无松动，咽侧壁稍充血，无压痛。如患者出现重度开口受限，以下颌角为中心的肿胀，皮肤潮红、压痛，此时应怀疑存在
A. 颞下间隙感染
B. 颞间隙感染
C. 颌下间隙感染
D. 翼颌间隙感染
E. 咬肌间隙感染

正确答案：E。咬肌间隙感染

解析：本题考查咬肌间隙感染的临床特点。下颌智牙冠周炎常引起咬肌间隙感染（E对），以下颌支及下颌角为中心的咬肌区肿胀、变硬、压痛伴明显张口受限，皮肤潮红、压痛。颞下间隙感染（A错）有深压痛，常存在相邻间隙的感染，可伴有颞部、腮腺咬肌区、颊部和口内上颌结节区的肿胀，同侧眼球突出、眼球运动障碍、眼睑水肿、头痛、恶心时，怀疑为海绵窦静脉炎。颞间隙感染（B错）的肿胀范围可局限于颞部，也可同时伴有腮腺咬肌区、颊部、眶部、颧部等区的广泛性肿胀，呈凹陷性水肿。颌下间隙感染（C错）早期表现为下颌下淋巴结炎，后扩散形成蜂窝织炎，易舌下间隙扩散。翼下颌间隙感染（D错）可向邻近间隙扩散，形成颞下、咽旁、下颌下、颌后等多间隙感染。